慢性毒性试验最主要目的是
A. 探讨阈剂量及最大无作用剂量
B. 探讨剂量反应关系
C. 预测有无潜在性危害
D. 为其他试验剂量设计提供依据

正确答案：A。探讨阈剂量及最大无作用剂量

解析：本题考查慢性毒性试验最主要目的。慢性毒性试验最主要目的是探讨阈剂量及最大无作用剂量（A对BCD错）。阈剂量是指外源化学物引起极个别的实验动物出现最轻微的损害作用所需的最小剂量或浓度。不引起实验动物出现任何有害作用的最大剂量被称为最大无作用剂量。